大剂量糖皮质激素突击治疗用于
A. 肾病综合征
B. 鹅口疮
C. 中毒性菌痢
D. 过敏性休克
E. 肾上腺皮质次全切术后

正确答案：C。中毒性菌痢

解析：短期应用于中毒性感染或同时伴有休克者，如中毒性菌痢、中毒性肺炎、严重伤寒、流行性脑脊髓膜炎、结核性脑膜炎及败血症等。利用大剂量糖皮质激素的抗炎、抗内毒素、抗休克作用，迅速缓解症状（C对）。